CO急性吸入毒性试验中，随CO浓度的增加，试验组大鼠死亡率也相应增加，体现
A. 效应
B. 反应
C. 剂量-效应关系
D. 剂量-反应关系
E. 有的个体不遵循剂量（效应）反应关系规律

正确答案：D。剂量-反应关系